某男，36岁。胸闷脘痞，小便短涩，大便不爽，属于湿邪所致。其病因性质是
A. 黏腻停滞
B. 阻遏气机
C. 收缩牵引
D. 凝结阻滞
E. 沉重秽浊

正确答案：B。阻遏气机

解析：本题考查的是湿邪的性质及治病特点。胸闷脘痞，小便短涩，大便不爽，属于湿邪所致。其病因性质是阻遏气机（B对）。湿为阴邪，易阻遏气机，损伤阳气：湿邪侵及人体，留滞于脏腑经络，最易阻遏气机，使气机升降失常，经络阻滞不畅，常可出现胸闷脘痞、小便短涩、大便不爽等症状。此外，湿为阴邪，易损伤阳气。脾主运化水湿，其性喜燥而恶湿，故外感湿邪，留滞体内，常先困脾气，使脾阳不振，运化水湿功能减弱，水湿停聚，出现腹泻、尿少、水肿、腹水等病证。病因，即指引起人体疾病的原因，又称致病因素、病邪。在中医病因学中六淫是最主要的发病因素之一。六淫即风、寒、暑、湿、燥、火六种外感病邪的统称。六淫的性质及致病特点为：1.风邪的性质及致病特点。（1）风为阳邪，其性开泄，易袭阳位。（2）风邪善行而数变。（3）风为百病之长。2.寒邪的性质及致病特点。（1）寒为阴邪，易伤阳气。（2）寒性凝滞，主痛：“凝滞”即凝结、阻滞（D错）不通之意。（3）寒性收引：收引，有收缩牵引（C错）之意。3.暑邪的性质及致病特点。（1）暑为阳邪，其性炎热。（2）暑性升散，耗气伤津。（3）暑多挟湿。4.湿邪的性质及致病特点。（1）湿为阴邪，易阻遏气机，损伤阳气。（2）湿性重浊（E错）：“重”，即沉重或重着之意。（3）湿性黏滞：“黏”，即黏腻，“滞”，即停滞（A错）。（4）湿性趋下，易伤阴位。5.燥邪的性质及致病特点。（1）燥性干涩，易伤津液。（2）燥易伤肺。6.火邪的性质及致病特点。（1）火热为阳邪，其性炎上。（2）火易伤津耗气。（3）火热易生风动血。（4）火热易发肿疡。